中医外科内治法中，益气托毒法的代表方是
A. 右归丸
B. 托里消毒散
C. 桃红四物汤
D. 神功内托散
E. 透脓散

正确答案：B。托里消毒散

解析：内托法是用补益和透脓托毒的药物扶助正气，托毒外出，使疮疡毒邪移深居浅，早日液化成脓，或使病灶趋于局限化，使邪盛者不致脓毒旁窜深溃，正虚者不致毒邪内陷，从而达到脓出毒泄、消肿痛止的目的，寓有“扶正达邪”之意。内托法可分为透托法和补托法两类，其中补托法又可分为益气托毒法和温阳托毒法。益气托毒法代表方为托里消毒散（B对）。右归丸功效温补肾阳，填精益髓，属于补益法助阳方的代表方剂（A错）。桃红四物汤功效养血止血，属于和营法活血化瘀方代表方剂（C错）。温阳托毒法代表方为神功内托散（D错）。透脓散为透托法代表方（E错）。